下列有关基础代谢中的叙述哪一项是错误的
A. 在基础状态下测定
B. 儿童高于成人
C. 反映人体最低的能量代谢水平
D. 临床常用相对值表示
E. 正常平均值相差±10%～±15%属于正常

正确答案：C。反映人体最低的能量代谢水平